根据《中华人民共和国药品管理法实施条例》，药品被抽验单位没有正当理由，拒绝抽查检验，国务院药品监督管理部门和被抽验单位所在地省级人民政府药品监督管理部门可以宣布
A. 该单位拒绝抽验的药品按假药处理
B. 该单位拒绝抽验的药品按劣药处理
C. 停止该单位拒绝抽验的药品上市销售和使用
D. 撤销该单位拒绝抽验药品的批准文号
E. 对该单位进行警告并限期整改

正确答案：C。停止该单位拒绝抽验的药品上市销售和使用

解析：本题考查药品抽查管理。根据《中华人民共和国药品管理法实施条例》，药品被抽验单位没有正当理由，拒绝抽查检验，国务院药品监督管理部门和被抽验单位所在地省级人民政府药品监督管理部门可以宣布停止该单位拒绝抽验的药品上市销售和使用（C对）。《中华人民共和国药品管理法实施条例》第八章药品监督第五十二条：药品抽样必须由两名以上药品监督检查人员实施，并按照国务院药品监督管理部门的规定进行抽样；被抽检方应当提供抽检样品，不得拒绝。药品被抽检单位没有正当理由，拒绝抽查检验的，国务院药品监督管理部门和被抽检单位所在地省、自治区、直辖市人民政府药品监督管理部门可以宣布停止该单位拒绝抽检的药品上市销售和使用。